哮喘反复发作的夙因是
A. 非时之感
B. 冒受风邪
C. 宿痰内伏
D. 壅塞之气
E. 肺脾气虚

正确答案：C。宿痰内伏

解析：该题主要考查哮喘的病因，理解记忆即可。哮喘的病因既有外因，也有内因。内因责之于肺、脾、肾三脏功能不足，导致痰饮留伏，隐伏于肺窍，故发作的夙因为宿痰内伏。人体水液的正常代谢为肺脾肾三脏所司，肺为水之上源，脾胃乃水谷之海，肾主人身水液，若三脏功能失调，则致水液代谢失常，痰浊内生（C对）。